女，30岁。车祸撞伤右上腹部40分钟，查体：P118次/分，BP90/60mmHg。痛苦貌，腹肌紧张，以右上腹为甚，有压痛反跳痛，右下腹穿刺抽出含胆汁的血液。术前处理最重要的环节是
A. 防治休克
B. 止血
C. 防治感染
D. 止痛
E. 镇静

正确答案：A。防治休克

解析：患者查体：P118次/分，BP90/60mmHg（收缩压≤90mmHg提示休克可能），休克指数（脉率/收缩压）为1.31，提示存在休克（休克指数＞1.0～1.5提示有休克）。休克可危及患者生命，属于优先处理的急症，故该患者术前处理最重要的环节是防治休克（A对）。患者无腹部开放性伤口，不需要进行止血（B错）。而患者右下腹穿刺抽出含胆汁的血液，提示有内部脏器破裂出血，应紧急行术中止血。患者发生车祸40分钟，短时间内不会出现危及生命的严重感染，故防治感染不属于术前处理最重要的环节（C错）。患者疼痛、精神紧张等都不会危及生命，故止痛（D错）和镇静（E错）并非术前处理最重要的环节。